对国务院各部门所作的具体行政行为提起诉讼的第一审行政案件由
A. 基层人民法院管辖
B. 中级人民法院管辖
C. 高级人民法院管辖
D. 最高人民法院管辖
E. 上一级人民法院管辖

正确答案：B。中级人民法院管辖

解析：本题考查行政诉讼管辖。对国务院各部门所作的具体行政行为提起诉讼的第一审行政案件由中级人民法院管辖（B对）。中级人民法院管辖下列第一审行政案件：①对国务院部门或者县级以上地方人民政府所作的行政行为提起诉讼的案件；②海关处理的案件；③本辖区内重大、复杂的案件；④其他法律规定由中级人民法院管辖的案件。基层人民法院管辖（A错）除上级人民法院管辖以外的第一审行政案件。即不满足中级人民法院管辖和高级人民法院管辖和最高人民法院管辖范围内的案件均应该由基层人民法院管辖。高级人民法院管辖（C错）本辖区重大、复杂的第一审行政案件。最高人民法院管辖（D错）全国范围内重大、复杂的第一审行政案件。